关于青春期龈炎的治疗及预后不正确的是
A. 局部药物治疗
B. 不易复发
C. 洁治术
D. 病程长、牙龈过度增生者可手术切除
E. 青春期过后，牙龈炎症可部分消退

正确答案：B。不易复发

解析：本题考查青春期龈炎。关于青春期龈炎的治疗及预后不正确的是不易复发（B错，为本题正确答案）。青春期龈炎的治疗：①通过洁治术（C对）去除菌斑、牙石。②必要时可配合局部的药物治疗（A对），如龈袋冲洗、局部上药及含漱等。多数患者经基础治疗后可痊愈。③对于个别病程长且牙龈过度肥大增生的患者，必要时可采用牙龈切除术（D对）。④完成治疗后应定期复查，必须教会患者正确刷牙和控制菌斑的方法，养成良好的口腔卫生习惯，以防止复发。⑤对于准备接受正畸治疗的青少年，应先治愈原有的牙龈炎，并教会他们正确的控制菌斑的方法。在正畸治疗过程中，定期做牙周检查和预防性的洁治。正畸矫治器的设计和制作应有利于菌斑控制。避免造成对牙周组织的刺激和损伤。青春期过后，牙龈炎症可部分消退（E对）。